能够刺激胃黏膜，反射性引起呼吸道分泌，使痰液变稀，易于咳出的药物是
A. 溴己新
B. 氯化铵
C. 氨茶碱
D. 乙酰半胱氨酸
E. 可待因

正确答案：B。氯化铵

解析：氯化铵（B对）属于黏液分泌促进剂，口服后刺激呼吸道腺体分泌增加，由于支气管腺体分泌物主要是浆液，从而使痰液稀释，易于咳出。溴己新（A错）属于黏痰溶解药，通过使痰液中的酸性黏蛋白纤维断裂，从而降低痰液粘稠度，适用于痰液粘稠引起的呼吸困难、咳痰困难。氨茶碱（C错）属于茶碱类支气管扩张药，对气道平滑肌具有直接松弛作用，在急性重度哮喘或哮喘持续状态时可采用氨茶碱静脉注射或滴注以迅速缓解喘息与呼吸困难等症状。乙酰半胱氨酸（D错）也属于黏痰溶解药，通过药物结构中的巯基与黏蛋白的二硫键的互换作用，使黏蛋白分子裂解从而降低痰液粘稠度。可待因（E错）对延髓咳嗽中枢具有选择性抑制作用，镇咳作用强而迅速，临床用于各种原因引起的剧烈干咳。